美托洛尔降低心肌收缩力的机制
A. α1受体激动剂
B. β2受体阻断剂
C. M受体激动剂
D. β1受体阻断剂
E. α2受体激动剂

正确答案：D。β1受体阻断剂

解析：美托洛尔通过选择性阻断β1受体，然后用于治疗各型高血压、心绞痛、心律失常、甲状腺功能亢进、心脏神经官能症、伴有左心室收缩功能异常的症状稳定的慢性心力衰竭患者（D对）。